关于生存曲线，正确的描述是
A. 生存曲线是一条阶梯型下降曲线
B. 生存曲线是一条指数下降曲线
C. 纵坐标为生存率
D. 横坐标中点为中位生存时间

正确答案：C。纵坐标为生存率

解析：本题考查生存曲线的相关内容。生存曲线是以观察（随访）时间为横坐标，以生存率为纵坐标（C对ABD错），将各个时间点所对应的生存率连接在一起的曲线图。